营养不良最先出现的症状是
A. 体重不增
B. 身长低于正常
C. 皮下脂肪减少或消失
D. 皮肤干燥，苍白，失去弹性
E. 肌张力低下，体温偏低，智力迟钝

正确答案：A。体重不增

解析：蛋白质-能量营养不良分为消瘦型营养不良、水肿型营养不良和消瘦-水肿型。①消瘦型营养不良，多见于1岁以内婴儿，其最早出现的症状是体重不增，继则体重下降，病程持久时身高也会低于正常（B错），同时智力发育受到影响（E错）。随病程的进展，皮下脂肪大量消失（C错），皮肤苍白、干燥、无弹性（D错），严重者皮肤皱缩、松弛，面部如老人貌，身高明显低于同龄儿；肌肉发育不良（E错），运动功能发育迟缓；精神萎靡，对外界刺激反应差；体温偏低（E错），心率缓慢，心音低钝；食欲低下，腹泻与便秘交替出现。②水肿型营养不良，常见于1～3岁幼儿，凹陷性水肿为本病的重要表现，常伴肝大，毛发干枯、脆细、稀疏、易脱落，指（趾）甲生长缓慢，薄脆易折，躯干及四肢常见过度色素沉着。③消瘦-水肿型营养不良的临床表现介于上述二者之间，故营养不良最先出现的症状是体重不增（A对）。